反映单位时间内充分发挥全部通气能力所达到的通气量称为
A. 最大随意通气量
B. 肺泡通气量
C. 补呼气量
D. 肺活量
E. 深吸气量

正确答案：A。最大随意通气量